股骨骨折后因处理不当，大量脂肪滴进入血液，该脂肪栓子常栓塞于
A. 肺静脉及其分支
B. 左心房
C. 左心室
D. 主动脉分支
E. 肺动脉及其分支

正确答案：E。肺动脉及其分支

解析：股骨骨折后处理不当时，直径较大的脂滴常进入下肢静脉，回流入心后再到达肺，栓塞于肺动脉及其分支（E对）；直径较小的脂滴可流经肺静脉及其分支（A错）后至左心，而后到达体循环分支引起全身多器官的栓塞。左心房（B错），左心室（C错）和主动脉分支（D错）的管腔较大，不易栓塞。